小儿前囟闭合最晚的时间是
A. 4～8月
B. 9～11月
C. 2岁
D. 19～24月
E. 25～30月

正确答案：C。2岁

解析：小儿前囟出生时约1～2cm，以后随颅骨生长而增大，6月龄左右逐渐骨化而变小，多于12-18个月闭合，最迟于2岁闭合（C对）。